男，35岁。间断咳嗽、咳痰伴咯血20年，最多一次伴咯血200ml。行高分辨率CT检查右肺中叶支气管囊状扩张，其余肺叶未见明显异常。今日再次咯血，量约100ml，给予静脉注射垂体后叶素治疗，效果欠佳，该患者宜选择的最佳治疗措施是
A. 病变肺叶肺动脉栓塞
B. 继续静脉滴注止血药
C. 支气管镜下止血
D. 换用酚妥拉明静脉滴注
E. 手术切除病变肺叶

正确答案：E。手术切除病变肺叶

解析：患者咳嗽、咳痰伴咯血（支气管扩张典型临表），高分辨率CT检查右肺中叶支气管囊状扩张，因此诊断为支气管扩张。患者咯血量不多，因此给与垂体后叶素治疗，但效果欠佳，且病变局限，因此最宜选择的治疗措施为手术切除病变肺叶（E对）。